能行气活血的味是
A. 辛
B. 苦
C. 酸
D. 咸
E. 甘

正确答案：A。辛

解析：本题考查的是五味对人体的效果。能行气活血的味是辛（A对）。五味对人体的效果：（1）辛：能散、能行，有发散、行气、活血作用。（2）甘（E错）：能补、能缓、能和，有补虚、和中、缓急、调和药性等作用。（3）酸（C错）：能收、能涩，有收敛固涩作用。另外，酸能生津、安蛔。（4）苦（B错）：能泄、能燥、能坚。（5）咸（D错）：能软、能下，有软坚散结、泻下通便作用。（6）涩：能收、能敛，同酸味一样有收敛固涩作用。（7）淡：能渗、能利，有渗湿利水作用。此外，还有芳香味，其能散、能行、能开，有化湿、辟秽、开窍、醒脾等作用。